男，28岁，拔牙前2%利多卡因局麻后，患者出现心悸、头晕、胸闷、面色苍白、全身冷汗、四肢厥冷无力、脉搏快而弱、血压下降。该患者情况属于
A. 中毒
B. 晕厥
C. 过敏反应
D. 癔病
E. 肾上腺素反应

正确答案：B。晕厥

解析：晕厥是一种突发性、暂时性意识丧失。通常是由于一时性中枢缺血所致。一般可因恐惧、饥饿、疲劳及全身健康较差等内在因素，以及疼痛、体位不良等外在因素所引起。临床表现：头晕、胸闷、面色苍白、全身冷汗、四肢厥冷无力、脉搏快而弱、恶心、呼吸困难；重者甚至有短暂的意识丧失。掌握“局部麻醉并发症及防治”知识点。